营养性巨幼红细胞性贫血神经系统表现
A. 智力及动作发育落后有倒退现象
B. 兴奋多动
C. 注意力不集中，记忆力减退
D. 腱反射减弱
E. 感觉异常

正确答案：A。智力及动作发育落后有倒退现象

解析：营养性巨幼红细胞性贫血神经系统症状：患者表情呆滞、嗜睡、对外界反应迟钝、少哭或不哭、智力发育和动作发育落后、甚至倒退，此外尚有不协调和不自主的动作，肢体、头、舌甚至全身震颤、肌张力增强，腱反射亢进，踝阵挛阳性，浅反射消失，甚至抽搐（A对，E错）；铁元素缺乏，出现缺铁性贫血，造成身体供血不足，影响大脑发育，引发多动症（B错）；缺铁性贫血患者常常有可能会出现注意力不集中，失眠多梦，然后入睡困难以及记忆力减退等神经系统的症状（C错）；巨幼红细胞贫血者神经系统病变可能致肌张力减退和腱反射减弱（D错）。